糖尿出现时，全血血糖浓度至少为
A. 8.89mmol/L（160mg/dl）
B. 11.11mmol/L（200mg/dl）
C. 27.78mmol/L（500mg/dl）
D. 66.67mmol/L（1200mg/dl）
E. 83.33mmol/L（1500mg/dl）

正确答案：A。8.89mmol/L（160mg/dl）